具有加强足三阴足三阳经脉与心脏联系的是
A. 别络
B. 皮部
C. 奇经
D. 经别
E. 经筋

正确答案：D。经别

解析：经别的生理功能：（1）加强十二经脉中为表里的两经在体内的联系；（2）加强体表与体内、四肢与躯干的向心性联系；（3）加强十二经脉与头面部的联系；（4）扩大十二经脉的主治范围；（5）加强足三阴、足三阳经脉与心脏的联系（D对）。